下列描述应用微生态治疗腹泻目的的是
A. 抑制病菌生长
B. 维持正常菌群
C. 促进营养成分的吸收
D. 减少肠道内毒素的生成
E. 促进胃酸分泌

正确答案：A、B、C、D。抑制病菌生长；维持正常菌群；促进营养成分的吸收；减少肠道内毒素的生成

解析：本题考查微生态治疗腹泻的目的。正常人体肠道内有400～500种菌群共同生长，相互依赖和制约。许多有益的细菌（益生菌）可制约致病菌的生长繁殖（A对），减少肠内毒素的生成（D对），维持肠道正常菌群的平衡（B对）；同时也促进人体对营养物质的吸收（C对）。例如双歧杆菌通过与肠黏膜上皮细胞作用而结合，与其他厌氧菌一起占据肠黏膜表面，形成一道生物屏障，阻止致病菌的侵入；复方嗜酸乳杆菌片（乳杆菌）含嗜酸乳杆菌，在肠内可抑制腐败菌的生长，防止肠内蛋白质的发酵，减少腹胀和止泻。双歧三联活菌胶囊含有双歧杆菌、乳酸杆菌和肠球菌。在肠内补充正常的生理细菌，维持肠道正常菌群的平衡，达到止泻的目的。